诊断下列疾病，采用的血清学诊断方法，下列哪项错误
A. 伤寒——肥达反应
B. 风湿热——抗O试验（ASO试验）
C. 斑疹伤寒——外斐反应
D. 支原体肺炎——冷凝集试验
E. 结核——结核菌素试验

正确答案：E。结核——结核菌素试验